患者，女，26岁，查体时发现下颌左侧第一前磨牙近远中邻（牙合）面有大面积银汞充填物，叩（-），X片显示已行根管治疗。最佳修复方式为
A. 金属全冠
B. 金属嵌体
C. 瓷嵌体
D. 桩核+金属全冠
E. 桩核+金属烤瓷全冠

正确答案：E。桩核+金属烤瓷全冠

解析：近远中邻面有大面积银汞充填物，提示残余牙体组织不多，难以使用全冠及嵌体修复。且X片显示已行根管治疗，死髓牙的脆性变大，很难满足修复体的固位形和抗力形。需要行桩核+金属烤瓷全冠（第一前磨牙考虑美观）。掌握“牙体缺损修复体固位及适应、禁忌证”知识点。